唾液腺肿瘤中最常见者的是
A. 混合瘤
B. 沃辛瘤
C. 腺样囊性癌
D. 腺泡细胞癌
E. 黏液表皮样瘤

正确答案：A。混合瘤

解析：本题考查唾液腺肿瘤。唾液腺肿瘤中最常见者的是混合瘤（A对）。多形性腺瘤（pleomorphic adenoma）又名混合瘤（mixed tumor），是唾液腺肿瘤中最常见者。沃辛瘤（Warthin tumor）（B错）又名腺淋巴瘤（adenolymphoma)或乳头状淋巴囊腺瘤。腺样囊性癌（C错）过去曾称为“圆柱瘤”，是常见的唾液腺恶性肿瘤之一。腺泡细胞癌（D错）是一种口腔涎腺低度恶性肿瘤，临床少见。黏液表皮样瘤（E错）也是黏液表皮样癌，是唾液腺恶性肿瘤中最常见者。